女，25岁。2年来在遇到不开心的事情时，出现四肢强直和抽搐样表现，发作时能听清楚家人的呼唤但不予回答，无唇舌咬伤和大小便失禁。查体瞳孔无散大，对光反射存在。该患者最可能的诊断是
A. 创伤应激障碍
B. 适应性障碍
C. 癫痫
D. 神经衰弱
E. 分离（转换）性障碍

正确答案：E。分离（转换）性障碍

解析：该患者2年来表现出四肢强直和抽搐样，发作时呼之不应（分离性抽搐），故诊断为分离（转换）性障碍（E对）。本例无唇舌咬伤和大小便失禁，查体瞳孔无散大，对光反射存在，故排除癫痫（C错）。创伤应激障碍症状的发生、发展与精神刺激因素（天灾人祸）的关系密切，表现为反复重现创伤性体验（频频出现内容非常清晰的，与创伤事件相关联的梦境），本例无此症状，故不考虑（A错）。